性寒，既清热化痰，又清心定惊的药是
A. 竹沥
B. 竹叶
C. 礞石
D. 海浮石
E. 天竺黄

正确答案：E。天竺黄

解析：本题考查的是天竺黄的性味归经与功效。性寒，既清热化痰，又清心定惊的药是天竺黄（E对）。天竺黄：【性味归经】甘，寒。归心、肝经。【功效】清热化痰，清心定惊。竹沥（A错）：【性味归经】甘，寒。归心、肺、胃经。【功效】清热滑痰。竹叶（B错）：【性味归经】甘、辛，寒。归心、肺经。【功效】清热除烦，生津，利尿。礞石（C错）：【性味归经】甘、咸，平。归肺、心、肝经。【功效】消痰下气，平肝镇惊。海浮石（D错）：【性味归经】咸，寒。归肺经。【功效】清热化痰，软坚散结，通淋。